影响种植体骨结合的因素是
A. 种植体的应力分布
B. 种植体材料的生物相容性
C. 患者自身条件
D. 手术创伤
E. 以上均是

正确答案：E。以上均是

解析：影响种植体骨结合的因素：手术创伤种植手术时，由下钻孔时产热，可使周围已分化和未分化的间叶细胞坏死。患者自身条件包括患者全身及局部的健康状况、牙槽突的质量和形态以及口腔卫生习惯等。种植体材料的生物相容性此点对骨结合的形成十分重要。种植体外形设计。种植体植入的部位、数量和方向，骨结合后义齿的修复处理，直接影响应力的分布。种植体植入后，应保证足够的骨愈合过程，待骨结合完成以后再作修复治疗。掌握“牙种植术概论”知识点。